问诊的内容应包括
A. 主诉、疾病发生情况、治疗史
B. 现病史、既往史、疾病发生过程
C. 主诉、 现病史、既往史、家族史
D. 主诉、治疗史、既往史、家族史
E. 主诉、现病史、既往史、治疗史

正确答案：C。主诉、 现病史、既往史、家族史

解析：本题考查问诊。问诊的内容应包括主诉、 现病史、既往史、家族史（C对）。问诊的内容包括主诉、现病史、既往史、个人史、婚育史、月经史和家族史等。